执业药师必须收集、整理、加工和利用的信息是
A. 药学信息
B. 药物信息
C. 遗传信息
D. 循证药物信息
E. 信息科学

正确答案：B。药物信息